属于无菌制剂的剂型是
A. 糖浆剂
B. 贴膏剂
C. 滴眼剂
D. 口服液
E. 胶囊剂

正确答案：C。滴眼剂

解析：本题考查的是滴眼剂的定义。属于无菌制剂的剂型是滴眼剂（C对）。滴眼剂：系指由原料药物与适宜辅料制成的供滴入眼内的无菌液体制剂。可分为溶液、混悬液或乳状液。糖浆剂（A错）：系指含有原料药物的浓蔗糖水溶液。贴膏剂（B错）：系指将原料药物与适宜的基质制成膏状物，涂布于背衬材料上供皮肤贴敷、可产生全身性或局部作用的一种薄片状制剂。口服液（D错）为单剂量灌装的合剂。胶囊剂（E错）系指原料药物或与适宜辅料充填于空心胶囊或密封于软质囊材中制成的固体制剂。